确诊苯胺中毒时，最有价值的血液检查指标是
A. 红细胞
B. 高铁血红蛋白
C. 血小板
D. 白细胞
E. 氰化血红蛋白

正确答案：B。高铁血红蛋白